与传递痛温觉冲动无关的结构
A. 脊髓后根
B. 脊神经节
C. 脊髓后角
D. 脊髓丘脑侧束
E. 丘脑内侧核

正确答案：E。丘脑内侧核

解析：痛温觉属于躯体和四肢的浅感觉之一，传导躯干和四肢痛温觉、粗略触觉和压觉传导通路的第1级神经元为脊神经节内假单极神经元（B对），位于脊神经后根节内（A对），经脊髓后角进入脊髓后索（C对），再终止于第2级神经元。第二级神经元发出纤维上升 1-2 个节段经白质前连合交叉到对侧的外侧索和前索内上行，组成脊髓丘脑侧束和脊髓丘脑前束（侧束传导痛温觉，前束传导粗略触觉和压觉）（D对），第3级神经元的胞体在背侧丘脑的腹后外侧核（E错，为本题正确答案）。